长期应用会出现柯兴综合征表现等不良反应的药物是
A. β-内酰胺类抗生素
B. 氨基糖苷类抗生素
C. 喹诺酮类抗菌药
D. 糖皮质激素类药物
E. 非甾体抗炎药

正确答案：D。糖皮质激素类药物